左、右心室都有的结构是
A. 室上嵴
B. 肉柱
C. 三尖瓣
D. 冠状窦
E. 窦房结

正确答案：B。肉柱

解析：肉柱（B对）为左、右心室都有的结构，且左心室肉柱较右心室细小。